为比较工人、干部中高血压患者所占比例是否不同，进行了χ²检验，算得χ²值为9.56，查表得χ²（0.05，1）=3.84，若取α=0.05，应得出的结论是
A. 拒绝π1=π2
B. 拒绝π1＞π2
C. 拒绝μ1=μ2
D. 接受π1=π2
E. 接受π1＞π2

正确答案：A。拒绝π1=π2

解析：X²检验主要目的是推断两个或多个总体率或构成比之间有无差别。该题的解题步骤为：（1）建立检验假设并确定检验水准。H0：π1=π2，即工人组与干部组中的高血压患者所占比例相同；H1：π1≠π2，即工人组与干部组中的高血压患者所占比例不同；α=0.05。（2）计算检验统计量。X²值为9.56。（3）确定P值，作出推断结论。X²＞X²（0.05，1）=3.84。取α=0.05水准，得出的结论是拒绝π1=π2。